男孩，6岁。高热伴剧烈咳嗽6天，既往体健，规范接种疫苗。查体：一般状况好，无明显呼吸困难，右中下肺呼吸减弱。胸部X线片示肺部薄云雾状浸润影，右侧胸腔少液。实验室检查：血WBC5.6×10⁹/L，N0.34，L0.66，PPD试验（一）。其最可能感染的病原体是
A. 肺炎支原体
B. 金黄色葡萄球菌
C. 结核分枝杆菌
D. 腺病毒
E. 肺炎链球菌

正确答案：A。肺炎支原体

解析：患儿学龄儿童，高热伴剧烈咳嗽6天，查体体征轻，血WBC5.6×10⁹/L（正常值4.0～10.0×10⁹/L），N0.34（正常值0.5～0.7），L0.66（正常值0.2～0.4），以淋巴细胞增多为主，胸部X线片示肺部薄云雾状浸润影，右侧胸腔少液，根据患儿病史、临床表现和辅助检查，最应考虑的诊断为肺炎支原体肺炎（A对）。金黄色葡萄球菌（B错）临床特点为起病急、病情严重、进展快，全身中毒症状明显。发热多呈弛张型，肺部体征出现较早，两肺有散在中、细湿啰音，可发生脓胸、脓气胸和各种类型的皮疹，X线检查可有小片状影，病变发展迅速，甚至数小时内可出现小脓肿、肺大疱或胸腔积液。结核分枝杆菌感染（C错）一般起病缓慢，可有低热、食欲不振、疲乏、盗汗等结核中毒症状，干咳和轻度呼吸困难是最常见的症状。查体可见周围淋巴结不同程度肿大，肺部体征可不明显，X线多呈小圆形或小片状影。（虽患者PPD试验（-），但不可仅根据PPD试验（-）而排除，仍可由于机体免疫功能低下或受抑制所致的假阴性反应。但本题根据患儿症状、体征、实验室检查，可排除结核分枝杆菌感染可能。）腺病毒（D错）起病急、中毒症状重、可有麻疹样皮疹，X线检查表现为大小不等的片状阴影或融合成大病灶，甚至一个大叶，没有肺大疱的表现。肺炎链球菌（E错）多表现为高热寒战、咳嗽、咳铁锈色痰，重症患者可有谵妄、昏迷等缺氧中毒性脑病的表现，X线显示大片均匀致密影，占全肺叶或一个节段，一般无皮疹。